就服务方式而言，社区卫生的综合性特点包括
A. 个体与群体相结合
B. 收费服务和免费服务
C. 持续性和非持续性
D. 门诊和家庭病床
E. 预防、治疗和康复相结合

正确答案：E。预防、治疗和康复相结合

解析：本题考查社区卫生服务的综合性特点。社区卫生服务的综合性特点，就服务方式而言，是利用一切对服务对象有利的方法与工具，包括现代医学、传统医学、替代医学的知识和技能，即将预防、治疗和康复相结合（E对ABCD错）的方法。